血液中H⁺浓度变化调节呼吸运动的主要刺激部位是
A. 颈动脉体和主动脉体
B. 支气管壁内肺牵张感受器
C. 颈动脉窦和主动脉弓
D. 肺毛细血管旁感受器
E. 延髓腹侧面化学感受器

正确答案：A。颈动脉体和主动脉体

解析：H⁺对呼吸的调节也是通过外周化学感受器和中枢化学感受器实现的。中枢化学感受器对H⁺的敏感性较外周化学感受器高，约为后者的25倍。但H⁺通过血-脑屏障的速度较慢，限制了它对中枢化学感受器的作用。因此，血液中的H⁺主要还是通过刺激位于颈动脉体和主动脉体（A对）的外周化学感受器来调节呼吸运动，而脑脊液中的H⁺主要刺激位于延髓腹侧面的中枢化学感受器（E错）起作用。支气管壁内肺牵张感受器（B错）感受肺扩张反射。颈动脉窦和主动脉弓（C错）是压力感受器。肺毛细血管旁感受器（D错）受到刺激引起反射性呼吸暂停，继以呼吸浅快、血压降低、心率减慢。